肾结核的典型症状是
A. 脓尿
B. 膀胱刺激症状
C. 终末血尿
D. 肾区疼痛和肿块
E. 全身中毒症状

正确答案：B。膀胱刺激症状

解析：肾结核的病变在肾脏，而症状表现在膀胱，其最具有特征性的临床表现是尿频、尿急、尿痛的慢性膀胱刺激症状（B对）。终末血尿是肾结核的重要症状（C错）。脓尿（A错）是肾结核的常见症状。腰痛（D错）发生较少，仅在少数肾结核病变破坏严重和梗阻，发生结核性脓肾或继发肾周感染， 或输尿管被血块、干酪样物质堵塞时，可引起腰部钝痛或绞痛。全身中毒症状（E错）为结核杆菌感染的典型表现，对肾结核的诊断不具有特异性。